垂危病人突然出现神清多语、两颧泛红如妆、意欲进食的表现的是
A. 神乱
B. 少神
C. 失神
D. 假神
E. 得神

正确答案：D。假神

解析：“望神就是观察人体生命活动的整体表现来判断病情的方法。假神，临床表现为原本目光晦滞，突然目似有光，但却浮光外露;；本为面色晦暗，一时面似有华，但为两颧泛红如妆；本已神昏或精神极度萎靡，突然神识似清，想见亲人，言语不休，但精神烦躁不安；原本身体沉重难移，忽思起床活动，但并不能自己转动；本来毫无食欲，久不能食，突然索食，且食量大增等。假神的出现，是因为脏腑精气极度衰竭，正气将脱，阴不敛阳，虚阳外越，阴阳即将离决所致，古人比作“回光返照”或“残灯复明”，常是危重病人临终前的征兆”，本题临床表现与之相符（D对）。“神乱指神志错乱失常，临床常表现为焦虑恐惧、狂躁不安、淡漠痴呆和卒然昏倒等，多见于癫、狂、痴、痫、脏躁等病人”，本题临床表现与之不相符（A错）。“少神又称‘神气不足’，临床表现为两目晦滞，目光乏神，面色少华，暗淡不荣，精神不振，思维迟钝，少气懒言，肌肉松软，动作迟缓。提示精气不足，机能减退，多见于虚证患者或疾病恢复期病人”，本题临床表现与之不相符(B错)。“失神又称‘无神’，分为精亏神衰而失神和邪盛神乱而失神，前者临床表现为两目晦暗，目无光彩，面色无华，晦暗暴露，精神萎靡，意识模糊，反应迟钝，手撒尿遗，骨枯肉脱，形体赢瘦。提示精气大伤，机能衰减，多见于慢性久病重病之人，预后不良。后者临床表现为神昏谵语，循衣摸床，撮空理线；或卒倒神昏，两手握固，牙关紧急。提示邪气亢盛，热扰神明，邪陷心包；或肝风夹痰蒙蔽清窍，阻闭经络。皆属机体功能严重障碍，气血津液失调，多见于急性病人，亦属病重”，本题临床表现与之不相符（C错）。“得神又称‘有神’，临床表现为两目灵活，明亮有神，面色荣润，含蓄不露，神志清晰，表情自然，肌肉不削，反应灵敏。提示精气充盛，体健神旺，为健康的表现，或虽病而精气未伤，病轻易治，预后良好”，本题临床表现与之不相符（E错）。